爱因斯坦说“在我的思维结构中，书面的或口头的文字似乎不起任何作用，作为思维元素的心理的东西是一些记号和有一定明晰程度的意向，由我随意的再生和组合”。这体现了思维种类是
A. 发散思维
B. 动作思维
C. 形象思维
D. 抽象思维
E. 聚合思维

正确答案：C。形象思维

解析：形象思维是以直观形象和表象为支柱的思维过程（C对）。发散思维，又称辐射思维、放射思维、扩散思维或求异思维，是指大脑在思维时呈现的一种扩散状态的思维模式。动作思维亦称直观动作思维。其基本特点是思维与动作不可分，离开了动作就不能思维。抽象思维，又称词的思维或者逻辑思维，是指用词进行判断、推理并得出结论的过程。抽象思维以词为中介来反映现实。聚合思维是指从已知信息中产生逻辑结论，从现成资料中寻求正确答案的一种有方向、有条理的思维方式。